致畸试验使用的最高剂量一股不超过该受试物LD₅₀的
A. 1/2
B. 1/4
C. 1/6
D. 1/8
E. 1/10

正确答案：A。1/2